在药品包装和标签上，无需印制特定字样或专有标识的是
A. 医疗用毒性药品
B. 含麻黄碱类复方制剂
C. 国家免疫规划疫苗
D. 含兴奋剂药品

正确答案：B。含麻黄碱类复方制剂

解析：本题考查含麻黄碱类复方制剂的管理。在药品包装和标签上，无需印制特定字样或专有标识的是含麻黄碱类复方制剂（B对）。含特殊药品复方制剂，从分类管理的角度来看，既有按处方药管理的、也有按非处方药管理的。但是，部分含特殊药品复方制剂（如含麻黄碱类复方制剂、含可待因复方口服溶液、复方地芬诺酯片和复方甘草片），因其所含成分的特性使之具有不同于一般药品的管理风险，如果管理不善导致其从药用渠道流失，则会被滥用或用于提取制毒。医疗用毒性药品（A错）属于特殊管理药品。根据《药品管理法》，特殊管理药品的包装和标签必须印有规定的标志。国务院药品监督管理部门规定的医疗用毒性药品的标志样式为黑白相间，白底黑字。疫苗生产企业应当在其供应的纳入国家免疫规划疫苗的最小外包装的显著位置，标明“免费”字样以及国务院卫生主管部门规定的“免疫规划”专用标识（C错）。含兴奋剂药品标签和说明书管理：《反兴奋剂条例》第十七条规定，药品中含有兴奋剂目录所列禁用物质的，生产企业应当在包装标识或者产品说明书上注明“运动员慎用”字样（D错）。药品经营企业在验收含兴奋剂药品时，应检查药品标签或说明书上是否按规定标注“运动员慎用”字样。根据《国家食品药品监督管理总局关于兴奋剂目录调整后有关药品管理的通告》（2015年第54号）的要求，兴奋剂目录发布执行后的第9个月首日起，药品生产企业所生产的含兴奋剂目录新列入物质的药品，必须在包装标识或产品说明书上标注“运动员慎用”字样。之前生产的，在有效期内可继续流通使用。